男孩，3岁，水肿一周。尿中有泡沫，尿量减少。查体：T36.7℃，P120次/分，BP90/60mmHg。眼险水肿，双下肢凹陷性水肿，双肺呼吸音粗，未闻及啰音，心前区未闻及杂音，腹膨隆，移动性浊音（＋）。尿常规：尿蛋白（+++）。尿沉渣镜检：RBC0～3/HP，WBC0～3/HP。血清白蛋白20g/L，胆固醇8.7mmol/L。以下治疗方式不合适的是
A. 给予氢氯噻嗪利尿
B. 给予泼尼松治疗
C. 给予青霉素抗感染治疗
D. 少盐饮食
E. 降脂治疗

正确答案：C。给予青霉素抗感染治疗

解析：男性幼儿患者，水肿一周。尿中有泡沫，尿量减少。眼睑水肿，双下肢凹陷性水肿。查体：T36.7℃（正常值36～37℃），BP90/60mmHg（正常值90～120/60～80mmHg）。尿常规：尿蛋白（+++）（＞3.5g/d）。血清白蛋白20g/L（＜30g/L），胆固醇8.7mmol/L（正常值成人2.9～6.0mmol/L，儿童3.1～5.2mmol/L）。尿沉渣镜检：RBC0～3/HP（正常值＜3/HP）。综合患者的症状、体征和辅助检查，最可能的诊断是单纯型肾病综合征。给予青霉素抗感染治疗（C错，为本题正确答案）适用于出现感染的病例，如肾炎性肾病综合征。给予氢氯噻嗪利尿（A对）以减轻水肿。初治病例诊断确定后应尽早给予泼尼松治疗（B对）。少盐饮食（D对）适用于显著水肿和严重高血压的短期治疗。降脂治疗（E对）以降低血脂。